某艾滋病女患者，出现严重的肺炎，痰涂片发现有孢子存在，试问最有可能的病原体是哪种
A. 曲霉菌
B. 新型隐球菌
C. 毛霉菌
D. 卡氏肺孢子菌
E. 小孢子癣菌

正确答案：D。卡氏肺孢子菌